药库相对湿度应保持在
A. 20%～30%
B. 30%～40%
C. 40%～50%
D. 35%～75%
E. 70%～85%

正确答案：D。35%～75%

解析：本题考查药库的相对湿度。药库的相对湿度应保持在35%～75%（D对）。可设置除湿机、排风扇或通风器，可辅用吸湿剂如石灰、木炭，有条件者，尤其在梅雨季节更要采取有效的防霉措施。